能促进胰岛素分泌的磺酰脲类降血糖药物是
A. 格列美脲
B. 米格列奈
C. 盐酸二甲双胍
D. 吡格列酮
E. 米格列醇

正确答案：A。格列美脲

解析：本题考查磺酰脲类胰岛素分泌促进剂类降糖药。格列美脲（A对）为磺酰脲类降血糖药。米格列奈（B错）为非磺酰脲类促胰岛素分泌药，盐酸二甲双胍（C错）为双胍类降糖药，吡格列酮（D错）噻唑烷二酮类胰岛素增敏剂，米格列醇（E错）是α-葡萄糖苷酶抑制剂，以上四种均无磺酰脲结构。